患者女，36岁，患风心病10年，近来心悸，胸闷痛，气短，下肢浮肿，尿少，数分钟前突然昏倒，意识丧失，皮肤苍白，唇绀，大动脉扪不到，呼吸停止，其原因是
A. 急性右心衰竭
B. 心脏性猝死
C. 脑栓塞
D. 急性左心衰竭
E. 癫痫大发作

正确答案：B。心脏性猝死

解析：患者女，36岁，患风心病10年（有发生猝死的基础疾病），近来心悸，胸闷痛，气短（前驱期症状），下肢浮肿，尿少（心肾功能不全）。心脏性猝死的诊断：1.神志消失，表现为意识突然丧失，昏倒于任何场合（患者突然昏倒，意识丧失）。2.无呼吸，或仅是喘息（患者呼吸停止）。3.大动脉（颈动脉或股动脉）搏动消失（患者大动脉扪不到）（B对）。急性右心衰竭表现为动脉系统低灌注征象，急性右心室扩张征象，外周静脉淤血征象（A错）。脑栓塞为突然起病，多于安静状态下发病。2.多见于有高血压、糖尿病及心脏病病史的中老年人。3.一般无头痛、呕吐、昏迷等全脑症状。4.有颈内动脉系统和（或）椎-基底动脉系统体征和症状，这些症状与体征可在发病后数小时至数天内加重达高峰。5.头颅CT、MRI发现梗死灶，并排除脑出血、瘤卒中等（C错）。急性左心衰竭以肺淤血及心排血量降低致组织器官低灌注等临床表现为主。表现为呼吸困难、咳嗽、咯痰、咯血、心肾功能不全症状（D错）。癫痫大发作也称全面性强直-阵挛发作，以意识丧失和全身抽搐为特征，额顶叶起源的癫痫类型多表现为癫痫大发作。发作起源于双侧大脑皮层及皮层下结构所构成的致痫网络中的某一点，并快速波及整个网络。每次发作起源点在网络中的位置均不固定。全面性发作时整个皮层未必均被累及，发作可不对称（E错）。